下列哪一点是流行病学实验研究不具备的
A. 随机化分组
B. 实验组和对照组是自然形成的
C. 必须有干预措施
D. 有严格的平行对照
E. 是前瞻性研究

正确答案：B。实验组和对照组是自然形成的